下列有关被动整塑说法不正确的是
A. 牵拉患者的唇部
B. 牵拉患者的颊部
C. 下颌向前向外拉动
D. 下颌向前向上拉动
E. 上颌应向前向下拉动

正确答案：C。下颌向前向外拉动

解析：被动修整时，术者手指轻轻牵拉患者的唇颊部，在上颌应向前向下拉动，而在下颌向前向上拉动。掌握“局部义齿的印模和模型”知识点。